经常性学校卫生监督，是指监督员对学校日常卫生工作进行的现场监督检查工作。监督检查工作的内容不应该包括哪一项
A. 建筑设备卫生
B. 学习和教室卫生
C. 学生用品
D. 体育锻炼和劳动安全
E. 学校食品卫生

正确答案：C。学生用品